男，13岁。额部不慎被锐器刺伤。查体：伤口周边红肿。行简单包扎10小时后就诊。额颞部有3cm长伤口，深及骨膜，有血痂。宜采取的处理方法是
A. 伤口膏药贴敷
B. 清创后一期缝合
C. 清创后予以包扎
D. 按感染伤口换药
E. 清创后延期缝合

正确答案：B。清创后一期缝合

解析：患者头皮裂伤24小时，且无明显感染征象，宜采取的处理方法是清创后一期缝合（B对）。